男，52岁。公司经理，吸烟10年，每天2包。从临床预防心血管疾病的角度讲应首选的检查是
A. 肝功能
B. 血常规
C. 冠状动脉造影
D. 血脂
E. 超声心动图

正确答案：D。血脂

解析：心血管疾病一级预防，指心血管疾病尚未发生或处于亚临床阶段时采取预防措施，通过控制或减少心血管疾病危险因素，预防心血管事件，减少群体发病率。本例患者中老年男性，长期大量吸烟，临床研究表明，吸烟使血中高密度脂蛋白含量下降，血清胆固醇含量增高，可使动脉粥样硬化的发病率和病死率较不吸烟者增高2～6倍（P213），动脉粥样硬化（P214）发病的危险因素还包括年龄、性别、血脂异常、糖尿病、肥胖和家族史等，其中脂质代谢异常是动脉粥样硬化最重要的危险因素。故从临床预防心血管疾病的角度讲应首选的检查是血脂（D对）。肝功能（A错）、血常规（B错）都是临床最常规的检查，对动脉粥样硬化的诊断有一定辅助作用，但并非预防心血管疾病的首选检查。冠状动脉造影（P222）（C错）操作复杂、价格昂贵，主要用于冠心病的确诊。超声心动图（E错）主要用于心脏和大血管的解剖结构及功能状态的诊断性检查。